胸腺非依赖性抗原是
A. TI-Ag
B. TD-Ag
C. T细胞依赖抗原
D. B细胞依赖抗原
E. T细胞辅助的抗原

正确答案：A。TI-Ag

解析：胸腺非依赖性抗原（TI-Ag）是指无需T细胞辅助即可直接刺激B细胞产生抗体的抗原。掌握“抗原基本概念、分类、超抗原及佐剂”知识点。